颌骨骨髓炎急性期的特点，除外
A. 发热、寒战
B. 疲倦无力、食欲缺乏
C. 白细胞总数降低
D. 中性粒细胞增高
E. 局部剧烈跳痛

正确答案：C。白细胞总数降低

解析：颌骨骨髓炎急性期的特点：全身发热、寒战、疲倦无力、食欲缺乏，白细胞总数增高，中性粒细胞增多；局部剧烈跳痛，口腔黏膜及颊部软组织肿胀、充血，可继发急性蜂窝组织炎；病源牙可有明显叩痛及伸长感。掌握“颌骨骨髓炎”知识点。